随着年龄的增长,牙齿（牙合）面和邻面由于咀嚼作用而发生的均衡的磨损称为
A. 磨损
B. 龋病
C. 磨耗
D. 酸蚀
E. 楔缺

正确答案：C。磨耗

解析：本题考查磨耗。随着年龄的增长，牙齿（牙合）面和邻面由于咀嚼作用而发生的均衡的磨损称为磨耗（C对）。1.磨耗是指在咀嚼过程中，由于牙面与牙面之间或牙面与食物之间的摩擦，使牙齿硬组织缓慢地、渐进性消耗的生理现象。牙的磨耗随年龄的增长而逐渐明显，多发生在牙的（牙合）面、切嵴及邻面。侧方咬合时，由于上颌磨牙的舌尖及下颌磨牙的颊尖，在工作侧有接触或非工作侧时也有接触，所以上述牙尖磨耗较多。前伸咬合时，上下颌前牙对刃后，下颌前牙切嵴即沿上颌前牙舌面向后上滑行回归至牙尖交错位，故下颌前牙切嵴磨耗较多。咀嚼时，各牙均有生理动度，相邻牙齿的接触点因相互摩擦而产生邻面磨耗。2.磨损（A错）一般指牙齿表面与外物机械性摩擦而产生的牙体组织损耗。3.龋病（B错）是在以细菌为主的多种因素影响下，牙体硬组织发生慢性进行性破坏的一种疾病。4.酸蚀性磨损（D错）是指由于受酸侵蚀引起的牙硬组织进行性丧失。5.楔状缺损（E错）是牙齿唇颊侧颈部硬组织发生缓慢消耗所致的缺损，由于这种缺损常呈楔形因而得名。